医疗卫生机构发现重大食物中毒事件后，应当在规定的时限内向所在地县级卫生行政部门报告。该时限是
A. 2小时
B. 1小时
C. 6小时
D. 12小时
E. 24小时

正确答案：A。2小时

解析：国务院2003年公布的《突发公共卫生事件应急条例》规定：医疗卫生机构发现重大食物中毒事件后，应当在2小时内向所在地县级人民政府卫生行政主管部门报告（A对）。